可减弱香豆素类药物抗凝血作用的药物是
A. 甲磺丁脲
B. 奎尼丁
C. 阿司匹林
D. 口服避孕药
E. 羟基保泰松

正确答案：D。口服避孕药

解析：口服避孕药（D对）可增加体内的凝血作用，可减弱香豆素类药物抗凝血作用。甲磺丁脲（A错）血浆蛋白结合率高，在蛋白结合上与其他药物如保泰松、水杨酸钠、双香豆素等发生竞争，使游离药物浓度上升，所以香豆素类药物浓度升高其抗凝作用增强。奎尼丁（B错）与双香豆素竞争与血浆蛋白结合，二者合用时使后者的抗凝作用增强。阿司匹林、保泰松可使血浆中游离香豆素类浓度升高，抗凝作用增强（CE错）。